根据《抗菌药物临床应用管理办法》，医疗机构对临床应用抗菌药物出现的异常情况，应开展调查并作出处理的情形包括
A. 用量异常增长
B. 偶发不良反应
C. 常超适应症使用
D. 经常超剂量使用
E. 半年内使用量始终居于前列

正确答案：A、C、D、E。用量异常增长；常超适应症使用；经常超剂量使用；半年内使用量始终居于前列

解析：本题考查的是抗菌药物应用异常情况调查。根据《抗菌药物临床应用管理办法》，医疗机构对临床应用抗菌药物出现的异常情况，应开展调查并作出处理的情形包括用量异常增长（A对）、常超适应症使用（C对）、经常超剂量使用（D对）、半年内使用量始终居于前列（E对）。抗菌药物应用异常情况调查：医疗机构应当对以下抗菌药物临床应用异常情况开展调查，并根据不同情况作出处理：使用量异常增长的抗菌药物；半年内使用量始终居于前列的抗菌药物；经常超适应症、超剂量使用的抗菌药物；企业违规销售的抗菌药物；频繁发生严重不良事件的抗菌药物（B错）。